葡萄糖的杂质检查项目有
A. 溶液的澄清度与颜色
B. 还原糖
C. 亚硫酸盐和可溶性淀粉
D. 蛋白质
E. 乙醇溶液的澄清度

正确答案：C、D、E。亚硫酸盐和可溶性淀粉；蛋白质；乙醇溶液的澄清度